女，68岁。清晨锻炼时突发心肌梗死，心跳骤停3分钟后实施心肺复苏，5分钟后心跳、呼吸恢复，10分钟后到医院。查体：P100次/分，BP100/65mmHg，浅昏迷，两侧瞳孔不等大。不必要的治疗措施是
A. 足量抗生素静滴
B. 呋塞米20mg静脉滴注
C. 物理降温使体温降至33℃-35℃
D. 高压氧疗
E. 20%甘露醇250ml静脉快速滴注

正确答案：A。足量抗生素静滴

解析：患者实施心肺复苏后浅昏迷，两侧瞳孔不等大，提示脑仍缺氧或水肿，应行降温（物理降温使体温降至33℃-35℃）（C对）、脱水（呋塞米20mg静脉滴注、20%甘露醇250ml静脉快速滴注）（BE对）、高压氧治疗（D对）等降低颅压，恢复脑灌注。心肌梗死并非细菌性感染疾病，此时运用抗生素没有意义（A错，为本题正确答案）。